对于A类型的预防性树脂充填，应该使用的修复材料为
A. 不含填料的封闭剂
B. 流动树脂材
C. 复合树脂材料
D. 玻璃离子
E. 氧化锌丁香油

正确答案：A。不含填料的封闭剂

解析：类型A预防性树脂充填：需用最小号圆钻去除脱矿牙釉质，用不含填料的封闭剂充填。掌握“预防性树脂充填”知识点。